常用作栓剂治疗给药的靶向制剂是
A. 常规脂质体
B. 微球
C. 纳米囊
D. pH敏感脂质体
E. 免疫脂质体

正确答案：B。微球

解析：本题考查靶向制剂。栓塞性制剂如栓塞微球（B对）和栓塞复乳用于阻断靶区的血供与营养，起到栓塞和靶向化疗作用。常规脂质体（A错）系一类由胆固醇和磷脂组成，含有脂质双层包围水相的内囊泡结构的脂质体。纳米囊（C错）属于被动靶向制剂的载药微粒。pH敏感脂质体（D错）根据肿瘤间质的pH比周围正常组织细胞的pH值低，选用对pH敏感的类脂材料为膜材制备成的载药脂质体。免疫脂质体（E错）是脂质体表面联接抗体，对靶细胞进行识别，提高脂质体的靶向性。后四者一般不用作栓剂治疗给药。